母核属于雄甾烷的蛋白同化激素药物是
A. 甲睾酮
B. 雌二醇
C. 达那唑
D. 丙酸睾酮
E. 苯丙酸诺龙

正确答案：E。苯丙酸诺龙

解析：本题考查甾体激素类药物。母核属于雄甾烷的蛋白同化激素类药物是苯丙酸诺龙（E对）。睾酮的化学结构为雄甾烷类，去除睾酮19位甲基得到苯丙酸诺龙。甲睾酮（A错）、丙酸睾酮（D错）是雄性激素，不属于蛋白同化激素。雌二醇（B错）是雌激素，母核为雌甾烷。达那唑（C错）为合成雄激素。